属于脑颅骨的是
A. 上颌骨
B. 颧骨
C. 泪骨
D. 筛骨
E. 腭骨

正确答案：D。筛骨

解析：额骨、筛骨、蝶骨、枕骨、颞骨和顶骨属于脑颅骨（D对）。面颅骨包括上颌骨（A错）、腭骨（E错）、颧骨（B错）、鼻骨、泪骨（C错）、下鼻甲、犁骨、下颌骨和舌骨。